属于青霉烷砜类抗生素的是
A. 氨曲南
B. 克拉维酸
C. 哌拉西林
D. 亚胺培南
E. 他唑巴坦

正确答案：E。他唑巴坦

解析：本题考查青霉烷砜类抗生素。他唑巴坦（E对）属于青霉烷砜类抗生素。舒巴坦为青霉烷砜类代表药。他唑巴坦是舒巴坦的衍生物。氨曲南（A错）单环β-内酰胺类。克拉维酸（B错）是氧青霉烷类。哌拉西林（C错）为青霉素类。亚胺培南（D错）为碳青霉烯类。